对于高血压患者制定牙周治疗计划，参考项正确的是
A. 舒张压90～109mmHg，牙周治疗同健康人
B. 舒张压＜120mmHg，可进行选择性的牙周治疗
C. 收缩压140～159mmHg，常规内科咨询
D. 收缩压90～99mmHg，常规内科咨询，每次就诊时测量血压
E. 收缩压≥180mmHg，可进行选择性的牙周治疗

正确答案：C。收缩压140～159mmHg，常规内科咨询

解析：血压状况对制订牙周治疗计划时的参考：高血压前期：收缩压120mmHg～139mmHg或舒张压80～89mmHg，牙周治疗同健康人。一期高血压：收缩压140～159mmHg或舒张压90～99mmHg，常规内科咨询，每次就诊时测量血压，告知患者其血压情况，牙周治疗同健康人，减小精神压力。二期高血压：收缩压＞160mmHg或舒张压＞100mmHg。告知患者血压情况，常规内科咨询，每次就诊时测量血压。如果收缩压＜180mmHg和舒张压＜110mmHg，可进行选择性的牙周治疗（常规检查，预防性洁治，牙周非手术治疗和牙体治疗）。高血压未治疗的患者不应给予常规的牙周治疗。如果收缩压≥180mmHg或舒张压≥110mmHg，建议立即进行内科治疗，只进行急症处理（以减轻疼痛、减少出血和感染），减小精神压力。掌握“牙周疾病与全身疾病和健康的关系”知识点。